《中华人民共和国刑法》规定生产、销售劣药，对人体健康造成严重危害
A. 处十年以上有期徒刑、无期徒刑或死刑，并处以罚金或没收财产
B. 处七年以上有期徒刑或者无期徒刑，并处以罚金或没收财产
C. 处七年以下有期徒刑，并处以罚金
D. 处三年以上十年以下有期徒刑，并处以罚金
E. 处五年以下有期徒刑，并处以罚金

正确答案：D。处三年以上十年以下有期徒刑，并处以罚金

解析：本题考查生产、销售劣药的法律责任。根据《刑法》第一百四十二条规定，生产、销售劣药，对人体健康造成严重危害的，处三年以上十年以下有期徒刑，并处罚金（D对）；后果特别严重的，处十年以上有期徒刑或者无期徒刑，并处罚金或者没收财产。本条所称劣药，是指依照《药品管理法》的规定属于劣药的药品。